凌晨，一位被汽车撞成重伤的少校军官被一位好心的老工人用三轮车送到某市医院急诊室。值班医师问刚刚苏醒过来的少校：“带钱了吗？”少校摇了摇头，又赶紧吃力地说：“我是现役军人，能报销……”话未说完又昏迷过去。医生给当地部队打电话。未能搞清伤者身份，于是睡觉去了。到早晨交接班时，发现少校军官已死于候诊室外长椅上。事后，某报记者走访了当事医师。他很委屈地说：“我多倒霉呀！白受了个处分。半夜里，他既没钱又没有伴，我怎么能相信他的话呢？医院里病人住院一分钱不交就溜走的还少吗？你去试试，不先交钱就给你看病的医院有哪家？”该值班医师出现过错的根源在于
A. 没有正确处理好市场经济带来的负效应问题
B. 没有正确处理好能不能做与应该不应该做的矛盾
C. 没有正确适应医学模式转变的要求
D. 没有正确适应高科技应用于医学的要求
E. 以上都不是

正确答案：A。没有正确处理好市场经济带来的负效应问题